下列抽样方法中误差较大的一种为
A. 随机抽样
B. 系统抽样
C. 分层抽样
D. 整群抽样

正确答案：D。整群抽样

解析：本题考查抽样方法的抽样误差。常见抽样方法抽样误差从小到大排列为：分层抽样≤系统抽样≤单纯随机抽样≤整群抽样（D对ABC错）。